重型肝炎与其他型肝炎的主要区别在于
A. 血清转氨酶明显升高
B. 肝脾肿大
C. 精神神经症状
D. 恶心呕吐明显
E. 黄疸明显

正确答案：C。精神神经症状

解析：重型肝炎表现一系列肝衰竭的表现：极度乏力，严重消化道症状，神经、精神系统症状（嗜睡、性格改变、烦躁不安、昏迷等），有明显出血现象等。其中神经、精神症状是其他型肝炎不常见的（C对）。